以下表述错误的是
A. 联合卡环有防止食物嵌塞的作用
B. 延伸卡环的卡臂在邻近缺隙的基牙上，位于非倒凹区，起固位作用
C. RPI卡环可减少基牙扭力
D. 远中孤立磨牙上的铸造圈卡的卡臂尖向近中
E. 对半卡环有两个（牙合）支托

正确答案：B。延伸卡环的卡臂在邻近缺隙的基牙上，位于非倒凹区，起固位作用

解析：延伸卡环：用于松动或牙冠外形差的基牙，将卡环臂延伸到邻近牙齿的倒凹区以获得固位和夹板固定作用。掌握“局部义齿固位体”知识点。